慢性肾盂肾炎是
A. 肾小管和肾间质的慢性化脓性炎症
B. 一种肾小球免疫复合物性肾炎
C. 一种以增生为主的炎症
D. 一种以变质为主的炎症
E. 肾小球肾炎的一种特殊类型

正确答案：A。肾小管和肾间质的慢性化脓性炎症

解析：慢性肾盂肾炎是肾小管和肾间质的慢性化脓性炎症（A对CD错），病变特点是慢性间质性炎症、纤维化和瘢痕形成，主要累及肾间质，很少累及肾小球（BE错）。